急性肺源性心脏病最常见的病因是
A. 重症肺结核
B. 支气管哮喘
C. 肺血栓栓塞
D. 过敏性肺炎
E. 慢性阻塞心肺疾病

正确答案：C。肺血栓栓塞

解析：急性肺源性心脏病是由于内源性或外源性栓子堵塞肺动脉或其分支使肺动脉循环阻力增加，心排血量降低，引起右心室急剧扩张和急性右心功能衰竭的临床病理生理综合征。急性肺源性心脏病最常见的病因是肺血栓栓塞（C对）。重症肺结核（A错）、支气管哮喘（B错）、过敏性肺炎（D错）和慢性阻塞心肺疾病（E错）等均为慢性肺源性心脏病的常见病因。